可致纵隔扑动的疾病是
A. 闭合性气胸
B. 张力性气胸
C. 开放性气胸
D. 血气胸
E. 脓胸

正确答案：C。开放性气胸

解析：纵隔扑动指由于两侧胸膜腔压力不均衡，出现周期性变化，使纵隔在吸气时移向健侧，呼气时移向患侧，见于开放性气胸（C对）、多根多处肋骨骨折。闭合性气胸（A错）、张力性气胸（B错）和血气胸（D错）可出现纵隔向健侧移位，但均不会出现纵隔扑动。急性脓胸时，纵隔可向健侧移位；慢性脓胸时，纵隔向患侧移位，都不会出现纵隔扑动（E错）。